苦味所示作用
A. 收敛固涩
B. 发散行气
C. 补虚缓急
D. 坚阴和通泄
E. 软坚散结，泻下通便

正确答案：D。坚阴和通泄

解析：本题考查的是五味对人体的效果。苦味所示作用坚阴和通泄（D对）。五味对人体的效果：（1）辛：能散、能行，有发散、行气（B错）、活血作用。（2）甘：能补、能缓、能和，有补虚、和中、缓急（C错）、调和药性等作用。（3）酸：能收、能涩，有收敛固涩（A错）作用。另外，酸能生津、安蛔。（4）苦：能泄、能燥、能坚。能泄的含义有三：一指苦能通泄，二指苦能降泄，三指苦能清泄。能燥即指苦能燥湿。能坚的含义有二：一指苦能坚阴，二指坚厚肠胃。（5）咸：能软、能下，有软坚散结、泻下通便（E错）作用。（6）涩：能收、能敛，同酸味一样有收敛固涩作用。（7）淡：能渗、能利，有渗湿利水作用。此外，还有芳香味，其能散、能行、能开，有化湿、辟秽、开窍、醒脾等作用。